配对设计的两组计量资料样本均数差别的检验
A. 只能用配对t检验
B. 只能用配伍组方差分析
C. 配对t检验与配伍组方差分析的结果一致
D. 只能用成组t检验
E. 只能用单因素方差分析

正确答案：C。配对t检验与配伍组方差分析的结果一致